生存分析中，用寿命表法估计生存率与直接法相比，其主要优点是
A. 计算简单
B. 可用于完全数据资料
C. 可用于未分组小样本资料
D. 可充分利用不完全数据的信息
E. 可用实测值绘制出生存率曲线

正确答案：D。可充分利用不完全数据的信息